关于拔除下颌智齿的步骤或方法，正确的说法是
A. 远中切口应偏舌侧
B. 颊侧切口与远中切口的末端呈90°向下
C. 只翻起黏膜瓣，将骨膜留在骨表面
D. 劈开牙冠时，牙冠应充分显露，且牙不松动
E. 涡轮钻拔牙术后反应较大

正确答案：D。劈开牙冠时，牙冠应充分显露，且牙不松动

解析：本题考查拔除下颌智齿的步骤或方法。拔除下颌智齿时，用锤凿法成功劈开的关键在于：牙冠发育沟清晰明显；牙冠部无龋坏；牙根分叉明显且分叉处高；锐利而合适的凿。劈开时，牙冠应充分显露，且牙不松动（D对），即冠部的骨阻力基本解除。翻瓣的远中切口从远中龈缘正中斜向后外方，勿偏舌侧（A错）。近中颊侧切口自邻牙的远中或近中颊面轴角处，与龈缘约成45°角，向前下勿超过移行沟底。颊侧切口与远中切口的末端应成钝角（B错），而不是呈90°角向下，以便能充分扩大手术视野。翻瓣由近中切口开始，沿骨面翻起，不可将骨膜与黏膜强力分离（C错），否则出血多、术野不清。涡轮机拔牙缩短了手术时间，拔牙震动小、痛苦小，配合吸引器，可使术野更清晰，创伤小，拔牙术后反应小（E错）。